引导性组织再生术的适应证，除外
A. Ⅱ度根分叉病变
B. Ⅳ度根分叉病变
C. 二壁骨下袋
D. 三壁骨下袋
E. 角型骨吸收

正确答案：B。Ⅳ度根分叉病变

解析：本题考查引导性组织再生术的适应证。引导性组织再生术的适应证，除外Ⅳ度根分叉病变（B错，为本题的正确答案）。Ⅳ度根分叉病变通常为截根术、分根术、牙半切术。引导性组织再生术（GTR）的适应证为骨内袋（CDE对）；Ⅱ度根分叉病变（A对）；仅涉及唇面的牙龈退缩，邻面无牙槽骨吸收且龈乳头完好者。